早期食管癌的症状是
A. 持续胸背痛
B. 声音嘶哑
C. 进食呛咳
D. 吞咽困难
E. 进食梗噎

正确答案：E。进食梗噎

解析：食管癌的早期症状不明显，仅可出现进食哽噎（E对）等轻微表现，症状时轻时重，进展缓慢。病人大多在出现明显症状后才前来就诊，此时食管癌多发展至中晚期。中晚期食管癌典型症状为进行性吞咽困难（D错）。当癌肿侵犯食管外组织可出现持续性胸背痛（A错）；侵犯喉返神经时可出现声嘶（B错）；侵犯气管、支气管时可出现进食呛咳（C错）等。